硝酸甘油与普萘洛尔合用治疗心绞痛
A. 能消除硝酸甘油引起的心率加快
B. 能消除普萘洛尔引起的心室容量增加
C. 可降低硝酸甘油引起的心肌收缩性增加
D. 可降低心内外膜血流比例
E. 可使侧支血流量减少

正确答案：A、B、C。能消除硝酸甘油引起的心率加快；能消除普萘洛尔引起的心室容量增加；可降低硝酸甘油引起的心肌收缩性增加

解析：本题考查联合用药。硝酸甘油与普萘洛尔合用治疗心绞痛能消除硝酸甘油引起的心率加快（A对）；能消除普萘洛尔引起的心室容量增加（B对）；可降低硝酸甘油引起的心肌收缩性增加（C对）。硝酸酯类进入平滑肌分解释放出NO，引起平滑肌松弛，冠脉扩张、心输出量增加。硝酸甘油与普萘洛尔合用，普萘洛尔减慢心率的作用能消除硝酸甘油引起的心率加快，硝酸甘油增加心输出量能消除普萘洛尔引起的心室容量增加。